球菌性口炎的主要致病菌是
A. 金黄色葡萄球菌、草绿色链球菌、肺炎双球菌、乳酸链球菌
B. 金黄色葡萄球菌、草绿色链球菌、肺炎双球菌、淋球菌
C. 脑膜炎球菌、草绿色链球菌、肺炎双球菌、溶血性链球菌
D. 金黄色葡萄球菌、草绿色链球菌、肺炎双球菌、溶血性链球菌
E. 溶血性链球菌、草绿色链球菌、肺炎双球菌、淋球菌

正确答案：D。金黄色葡萄球菌、草绿色链球菌、肺炎双球菌、溶血性链球菌

解析：主要致病菌有金黄色葡萄球菌、草绿色链球菌、溶血性链球菌、肺炎双球菌等。口腔黏膜球菌感染往往是几种球菌同时致病，引起口腔黏膜的急性损害。掌握“球菌性口炎”知识点。